中枢神经系统内，兴奋的化学传递特征中，下列哪项是错误
A. 单向传递
B. 中枢延搁
C. 总和
D. 兴奋节律不变
E. 易受内环境条件改变的影响

正确答案：D。兴奋节律不变